双氯芬酸片的适宜服用时间是
A. 早晨
B. 餐前
C. 餐中
D. 餐后
E. 睡前

正确答案：D。餐后

解析：本题考查药品服用的适宜时间。双氯芬酸适宜于餐后（D对）服用，以减少对胃肠的刺激。适宜清晨（A错）服用的药物有糖皮质激素类、抗抑郁药、利尿药、驱虫药、泻药等。适宜餐前（B错）服用的药物有胃黏膜保护剂、收敛药、促胃动力药等。适宜餐中（C错）服用的药物有助消化药、肝胆辅助用药、减肥药、抗结核药等。适宜睡前（E错）服用的药物有催眠药、平喘药、调节血脂药、抗过敏药、缓泻药等。